为了保护亚胺培南，防止其在肾中破坏，应与其配伍的药物是
A. 克拉维酸
B. 舒巴坦
C. 他唑巴坦
D. 西司他丁
E. 苯甲酰氨基丙酸

正确答案：D。西司他丁

解析：本题考查药物的联合应用。西司他丁（D对）是一种特异性酶抑制剂，能阻断亚胺培南在肾脏内的代谢，从而提高原形药物的浓度，提高药效。